对米非司酮描述错误的是
A. 具有孕甾烷结构
B. 具有抗孕激素作用
C. 具有抗皮质激素作用
D. 具有独特代动力学性质，半衰期较长
E. 具有抗早孕用途，应与米索前列醇合用

正确答案：A。具有孕甾烷结构